大叶性肺炎实变期不应出现的体征是
A. 胸膜摩擦音
B. 肺部叩诊浊音
C. 气管向健侧移位
D. 可听到湿罗音
E. 可听到支气管呼吸音

正确答案：C。气管向健侧移位

解析：大叶性肺炎早期肺部体征无明显异常，仅有胸廓呼吸运动幅度减小，叩诊浊音，听诊可有呼吸音减低及胸膜摩擦音（A对）。肺实变时叩诊浊音（B对），触觉语颤增强并可闻及支气管呼吸音（E对），消散期可闻及湿啰音（D对）。而气管向健侧移位（C错，为本题正确答案），多见于胸腔积液和气胸，大叶性肺炎时，气管居中。